属于药物流行病学研究的内容有
A. 应用横断面调查研究方法调查老年患者镇静催眠药滥用情况
B. 西立伐他汀与贝丁酸类药物联合使用，导致横纹肌溶解症的病例对照研究
C. 高效液相色谱法测定尼尔雌醇片中尼尔雌醇的含量
D. 高效液相色谱法测定血浆桉油精的含量
E. 奥美拉唑胶囊体内药物动力学研究

正确答案：A、B。应用横断面调查研究方法调查老年患者镇静催眠药滥用情况；西立伐他汀与贝丁酸类药物联合使用，导致横纹肌溶解症的病例对照研究

解析：本题考查药物流行病学。药物流行病学的研究方法主要有描述性研究、分析性研究和实验性研究。应用横断面调查研究方法调查老年患者镇静催眠药滥用情况（A对）属于描述性研究。西立伐他汀与贝丁酸类药物联合使用，导致横纹肌溶解症的病例对照研究（B对）属于分析性研究。高效液相色谱法测定尼尔雌醇片中尼尔雌醇的含量（C错）属于药品质量检验范畴。高效液相色谱法测定血浆桉油精的含量（D错）属于体内药物检测的内容。奥美拉唑胶囊体内药物动力学研究（E错）属于药物动力学研究。